下列哪个腧穴是足阳明胃经的原穴
A. 冲阳
B. 内庭
C. 厉兑
D. 解溪
E. 足三里

正确答案：A。冲阳

解析：冲阳为胃之原穴（A对）；内庭（B错）为胃之荥穴；厉兑（C错）为胃之井穴；解溪（D错）为胃之经穴；足三里（E错）为胃之合穴、胃下合穴。